在延髓的躯体运动核是
A. 疑核
B. 副神经核
C. 迷走神经背核
D. 展神经核
E. 舌下神经核

正确答案：E。舌下神经核

解析：舌下神经核（E对）位于延髓，属于 一般躯体运动核；疑核（A错）位于下橄榄核和第四脑室周围灰质间的网状结构内；副神经核（B错）属于特殊内脏运动核；迷走神经背核（C错）属于一般内脏运动核；展神经核（D错）位于脑桥下部，面神经丘的深面。